根据《行政许可法》，药品监督管理部门应当作出撤销行政许可决定的情形是
A. 药品监督管理部门发现申请人申报《药品经营许可证》的申请材料不全和有误，需要补全和修改
B. 设区的市级药品监督管理部门依申请发给一家中药饮片企业《药品经营许可证》（零售）
C. 某药品零售企业取得一项行政许可后，当地政府决定调整该行政许可的管理部门，由设区的市级药品监督管理部门改为县级药品监督管理部门
D. 药品监督管理部门在监督检查中发现，辖区内一家药品零售企业申请开办时存在经营场所房屋产权材料造假行为

正确答案：D。药品监督管理部门在监督检查中发现，辖区内一家药品零售企业申请开办时存在经营场所房屋产权材料造假行为

解析：本题考查的是撤销行政许可的情形。根据《行政许可法》，药品监督管理部门应当作出撤销行政许可决定的情形是药品监督管理部门在监督检查中发现，辖区内一家药品零售企业申请开办时存在经营场所房屋产权材料造假行为（D对）。撤销行政许可的情形：按照《行政许可法》规定，作出行政许可决定的行政机关或者其上级行政机关，根据利害关系人的请求或者依据职权，可以撤销行政许可：1.行政机关工作人员滥用职权、玩忽职守作出准予行政许可决定的。2.超越法定职权作出准予行政许可决定的。3.违反法定程序作出准予行政许可决定的。4.对不具备申请资格或者不符合法定条件的申请人准予行政许可的。5.依法可以撤销行政许可的其他情形。被许可人以欺骗、贿赂等不正当手段取得行政许可的，应当予以撤销。同时《行政许可法》也规定，如果按照上述情形撤销行政许可，可能对公共利益造成重大损害的，不予撤销。